乳突窦(鼓窦)是
A. 不含气的小腔
B. 向上与鼓室相通
C. 向后与乳突小房相通连
D. 中耳炎绝不累及它
E. 直而长

正确答案：C。向后与乳突小房相通连

解析：乳突窦位于鼓室上隐窝的后方，向前开口于鼓室后壁的上部（B错），向后与乳突小房相连通（C对），为鼓室和乳突小房之间的通道。中耳炎可经乳突窦（D错）侵犯乳突小房而引起乳突炎。